示指腱鞘炎易蔓延至
A. 掌中间隙
B. 鱼际间隙
C. 桡侧滑液囊
D. 尺侧滑液囊
E. 中指骨膜下间隙

正确答案：B。鱼际间隙

解析：手的化脓性腱鞘炎多为局部刺伤后继发细菌感染，亦可由掌部感染蔓延所致，致病菌多为金黄色葡萄球菌。手指的腱鞘炎可沿各自的解剖学途径蔓延。示指腱鞘炎的蔓延途径为经腱鞘至鱼际间隙（B对）。掌中间隙（A错）为中指与环指腱鞘炎的蔓延部位；桡侧滑液囊（C错）与拇指的腱鞘相沟通，拇指的腱鞘炎可蔓延至此；尺侧滑液囊（D错）与小指的腱鞘相沟通，小指的腱鞘炎可蔓延至此。具体可参见（P112）“图11-2 手掌侧的腱鞘、滑液囊和深间隙”（B对）。